水鼓病证，当腹水严重，腹部胀满，二便不利时，应选用的治疗原则是
A. 治标
B. 治本
C. 标本兼治
D. 先治本后治标
E. 扶助正气

正确答案：A。治标

解析：治标适用于标症紧急时，若不及时处理会危及生命，当以控制症状为首务；水鼓患者，当出现腹水严重，腹部胀满，呼吸急促，二便不利时，应当先治标病之腹水（A对）。治本适用于病情缓和，病势迁延，暂无急重病症的情况（B错）；标本兼治适用于标本并重或标本俱缓，但单纯治标或治本都不易收效的情况（C错）；标本的先后缓急取舍，应当根据病情的实际情况而定（D错）；扶助正气适用于各种虚证（E错）。